侵犯喉返神经引起声带麻痹时，咳嗽的特征为
A. 咳嗽，声音嘶哑
B. 金属音调咳嗽
C. 犬吠样咳嗽
D. 咳嗽声音低微
E. 阵发性痉挛性咳嗽

正确答案：A。咳嗽，声音嘶哑

解析：喉返神经损伤的患者是很有可能导致咳嗽的主要是由于双侧声带近中线，呼吸时不能外转，声音不受影响患者双侧喉返神经的损伤通常有短暂的声音嘶哑时，咳嗽的很弱